调节进入眼内光线量的是
A. 瞳孔
B. 巩膜静脉窦
C. 虹膜角膜角
D. 视神经盘
E. 黄斑中央凹

正确答案：A。瞳孔

解析：调节进入眼内光线量的是瞳孔（A对）。